脊髓后索受损伤时
A. 闭眼时指鼻不准确
B. 受损的对侧有痛觉障碍
C. 闭眼时能确定关节的位置
D. 闭眼时身体直立不摇晃
E. 闭眼时不能确定各关节的位置

正确答案：E。闭眼时不能确定各关节的位置

解析：薄、楔束传导同侧躯干及上下肢的肌、腿、关节的本体感觉（位置觉、运动觉和震动觉）和皮肤的精细触觉（如通过触摸辨别物体纹理粗细和两点距离）信息。当脊髓后索病变时，本体感觉和精细触觉的信息不能向上传至大脑皮质。病人闭目时，不能确定关节的位置和方向，运动时出现感觉性共济失调。此外，病人精细触觉丧失（E对）。